患者，男，右侧腮腺区反复肿胀3年，腮腺区发胀，口内时有咸味。如诊断为慢性阻塞性腮腺炎，腮腺造影的表现为
A. 造影剂外溢
B. 有占位性病变
C. 导管中断或圆形充盈缺损
D. 主导管呈葱皮样改变
E. 主导管扩张，呈腊肠样改变

正确答案：E。主导管扩张，呈腊肠样改变

解析：本题考查慢性阻塞性腮腺炎。腮腺造影显示主导管、叶间、小叶间导管部分狭窄、部分扩张，呈腊肠样改变（E对）。部分伴有“点状扩张”，但均为先有主导管扩张，延及叶间、小叶间导管后，才出现“点状扩张”。